水痘患者常出现
A. 血红蛋白减少
B. 中性粒细胞增多
C. 嗜酸性粒细胞增多
D. 血小板计数增多
E. 淋巴细胞增多

正确答案：E。淋巴细胞增多

解析：本题考查血常规检查。水痘患者常出现淋巴细胞增多（E对）。淋巴细胞增多：①传染病：主要见于病毒感染，如传染性淋巴细胞增多症、结核病、水痘、麻疹、风疹、流行性腮腺炎，也可见于百日咳杆菌、布鲁菌等感染。②血液系统疾病：急、慢性淋巴细胞白血病，淋巴瘤等。③移植排斥反应。血红蛋白减少（A错）常见于缺铁性贫血。中性粒细胞增多（B错）见于急性感染、糖尿病酮症酸中毒、汞中毒、白血病、急性大出血等。嗜酸性粒细胞增多（C错）见于支气管哮喘、荨麻疹、湿疹、钩虫病、嗜酸性粒细胞白血病等。血小板计数增多（D错）见于慢性粒细胞白血病、真性红细胞增多症、急性感染、急性溶血等。